处方后记不包括
A. 处方编号
B. 医师签名
C. 配方人签名
D. 核对人签名
E. 发药人签名

正确答案：A。处方编号

解析：本题考查处方。处方后记不包括处方编号（A错，为本题正确答案）。处方后记有医师签名（B对）或加盖专用签章，药品金额以及审核、调配（C对）、核对（D对）、发药（E对）的药学专业技术人员签名或加盖专用签章。